薄荷、牛蒡子除均可疏散风热外，还具有的功效是
A. 利咽透疹
B. 宣肺祛痰
C. 明目退翳
D. 息风止痉
E. 疏肝理气

正确答案：A。利咽透疹

解析：薄荷与牛蒡子两者均可疏散风热、利咽透疹，但薄荷还能清利头目，疏肝理气，牛蒡子则兼能宣肺祛痰，可清热解毒散肿。两者均无明目退翳，息风止痉之功（A对）